女，35岁。车祸后昏迷，被送至医院3小时后清醒。查体：神志尚清双侧眶周青紫，右鼻孔有血性液体流出，嗅觉丧失，能遵嘱活动。错误的处理是
A. 注射抗生素
B. 鼻腔填塞
C. 卧床休息
D. 抬高头位
E. 应用镇静剂

正确答案：B。鼻腔填塞

解析：青年患者，车祸后昏迷，3小时后清醒，查体：神志尚清双侧眶周青紫，右鼻孔有血性液体流出（提示脑脊液漏），嗅觉丧失（颅底骨折的典型体征），根据患者的临床症状及体征，考虑诊断为颅底骨折合并脑脊液漏，错误的处理措施是鼻腔填塞，病人须取头高位（D对）并绝对卧床休息（C对），避免用力咳嗽、打喷嚏和擤鼻涕，同时给予抗生素（A对）预防颅内感染治疗，一般不堵塞（B错，为本题正确答案）或冲洗破口处，不做腰穿。若疼痛较重者可应用适量镇静剂（E对）。